某女，63岁。头晕目眩，耳鸣耳聋，五心烦热，口燥咽干，腰膝酸软，舌红苔少，脉细数。辨证是
A. 肾阴阳两虚
B. 肾阳虚
C. 肾气虚
D. 肾精不足
E. 肾阴虚

正确答案：E。肾阴虚

解析：本题考查的是肾阴虚的临床表现。头晕目眩，耳鸣耳聋，五心烦热，口燥咽干，腰膝酸软，舌红苔少，脉细数。辨证是肾阴虚（E对）。肾病的主要证候有肾阳虚证、肾阴虚证、肾精不足证、肾气不固证及肾不纳气证。1.肾阳虚（B错）证的临床表现及辨证要点：肾阳虚证的临床表现，常见形寒肢冷，精神不振，腰膝酸软，或阳痿不举，舌淡苔白，脉沉迟或两尺无力。一般以全身功能低下伴见寒象为辨证要点。2.肾阴虚证的临床表现及辨证要点：肾阴虚证的临床表现，常见头晕目眩，耳鸣耳聋，牙齿松动，失眠遗精，口燥咽干，五心烦热，盗汗，腰膝酸痛，舌红，脉细数。一般以肾病的主要症状和阴虚内热症状同见为辨证要点。3.肾精不足（D错）证的临床表现及辨证要点：肾精不足证的临床表现，常见男子精少不育，女子经闭不孕，性功能减退。小儿发育迟缓，身材矮小，智力和动作迟钝，囟门迟闭，骨骼痿软。成人早衰，发脱齿摇，耳鸣耳聋，健忘恍惚，动作迟缓，足痿无力，精神呆钝等。一般以小儿生长发育迟缓、成人早衰、生殖功能减退的表现为辨证要点。4.肾气不固证与肾不纳气证（C错）的临床表现及辨证要点：肾气不固证的临床表现，常见滑精早泄，尿后余沥，小便频数而清，甚则不禁，腰脊酸软，面色淡白，听力减退，舌淡苔白，脉细弱。一般以肾及膀胱不能固摄表现的症状为辨证要点。肾不纳气证的临床表现，常见气虚喘促，呼多吸少，动则喘甚，汗出，四肢不温，恶风寒，面部虚浮，舌质淡，脉虚弱。一般以久病咳喘、呼多吸少、气不得续、动则加重为主，伴见肺肾气虚表现为辨证要点。肾阴阳两虚（A错）的临床表现，2022年考试指南未明确说明。